桡骨颈骨折最易损伤的神经是
A. 桡神经主干
B. 尺神经
C. 桡神经浅支
D. 桡神经深支
E. 共12对

正确答案：D。桡神经深支

解析：桡神经深支位于桡骨颈外侧，所以桡骨颈骨折最易损伤的神经是为桡神经深支（D对）。